下列不属于修复体松动、脱落原因的是
A. 桩过长
B. 修复体不密合
C. 轴壁聚合度过大
D. （牙合）龈距太短
E. 修复体粘固面未清洗干净

正确答案：A。桩过长

解析：修复体松动、脱落原因。①修复体固位不足，如轴壁聚合度过大，（牙合）龈距太短，修复体不密合，桩过短，固位型不良。②咬合创伤、（牙合）力过大，（牙合）力集中，侧向力过大。③粘固失败。如粘固时材料选用不当，粘固剂失效，牙面及修复体粘固面未清洗干净，干燥不彻底，油剂、唾液污染，粘固剂尚未完全结固时，患者咀嚼破坏了结固等。掌握“修复体戴入后的问题及处理”知识点。